女，48岁。外阴瘙痒伴灼热感3天。妇科检查：见外阴红肿、小阴唇内侧及阴道黏膜表面有白色凝乳状物覆盖。该患者首先考虑为
A. 前庭大腺炎
B. 淋菌性阴道炎
C. 外阴阴道念珠菌病
D. 滴虫性阴道炎
E. 细菌性阴道炎

正确答案：C。外阴阴道念珠菌病

解析：该患者出现外阴瘙痒伴烧灼感（外阴阴道念珠菌病的主要表现为外阴瘙痒、灼痛、性交痛以及尿痛），外阴局部充血小阴唇内侧及阴道黏膜表面有白色片状薄膜或凝乳状物（妇检可见外阴红斑、水肿，小阴唇内侧及阴道黏膜附有白色块状物），首先考虑为外阴阴道念珠菌病（C对）。细菌性阴道炎（E错）主要表现为分泌物增多，有鱼腥臭味，尤其性交后加重。检查见阴道黏膜无充血的炎症表现，分泌物特点为灰白色、均匀一致、稀薄，常黏附于阴道壁，易拭去。淋菌性阴道炎（B错）主要有阴道脓性分泌物增多，外阴瘙痒或灼热，偶有下腹痛，妇检可见宫颈水肿、充血等宫颈炎表现。滴虫性阴道炎（D错）主要症状是阴道分泌物增多及外阴瘙痒，分泌物呈稀薄脓性、黄绿色、泡沫状、有臭味。前庭大腺炎（A错）主要表现为外阴一侧的急性炎症表现，即外阴局部的红、肿、热、痛，当病程较长时，可形成前庭大腺脓肿，若自发破溃可有脓液溢出。